哪种药物可减少尿蛋白
A. 噻嗪类利尿剂
B. 血管紧张素转换酶抑制剂
C. 潴钾利尿剂
D. 袢利尿剂呋塞米
E. 血浆白蛋白

正确答案：B。血管紧张素转换酶抑制剂

解析：噻嗪类利尿药主要机制为通过作用于髓袢升支远端和远曲小管近端，抑制钠离子和氯离子的重吸收而引起排钠利尿作用。其主要作用是消除水肿（A错）。ACEI可以通过降低系统血压和肾内血压，改善肾小球滤过膜的通透性，减少蛋白尿的排出、抑制肾组织细胞的硬化过程，包括系膜细胞、内皮细胞和小管上皮细胞以及间质成纤维细胞增殖，分泌趋化因子、炎症因子和促纤维因子，从而抑制肾组织炎症反应和硬化（B对）。潴钾利尿剂，拮抗醛固酮受体，阻滞管腔Na+通道只从而减少Na⁺重吸收，抑制K⁺分泌（C错）。袢利尿剂呋塞米是一种短效袢利尿剂，主要通过防止钠和氯的重吸收来增加钠和氯的消除（D错）。血浆白蛋白是存在于血浆中的水溶性很高的球状蛋白质，可以增加血容量和维持血浆胶体的渗透压，对球蛋白起到一种胶体保护的稳定作用，运输和解毒的作用（E错）。